口腔预防医学的基本要素是
A. 研究特定人群的预防措施
B. 研究个人预防保健方法
C. 研究口腔疾病的发生，发展规律
D. 得到政府的支持
E. 得到口腔专业人员的指导

正确答案：B。研究个人预防保健方法

解析：本题考查口腔预防医学的基本要素。研究个人预防保健方法（B对）是口腔预防医学的基本要素。口腔预防医学以人群为主要对象，以群体口腔疾病患病情况、群体预防措施（A错）和个人预防保健方法为基本要素，发现并掌握预防口腔疾病的发生发展规律，促进整个社会口腔健康水平的提高。研究口腔疾病的发生，发展规律（C错）是口腔预防医学研究的意义。得到政府的支持（D错）、得到口腔专业人员的指导（E错）是口腔预防医学研究的要求。口腔预防医学的研究除口腔专业人员和卫生工作者之外，它还要求政府的支持和投入、社会的关注以及个人的参与。